延伸卡环除了固位作用之外，还具有
A. 应力中断作用
B. 防止食物嵌塞作用
C. 夹板固定作用
D. 防龋作用
E. 自洁作用

正确答案：C。夹板固定作用

解析：本题考查延伸卡环的特点。延伸卡环将卡环臂延伸至进缺隙基牙的相邻牙的倒凹区以获得固位，并对松动基牙有夹板固位作用（C对）。延伸卡环没有应力中断作用（A错），回力卡环上由于远中（牙合）支托不直接与基托相连接，（牙合）力先通过人工牙和基托传到黏膜和牙槽嵴，再迁回传至基牙，这就减轻了基牙的负荷，这种作用称为应力中断作用。延伸卡环的卡环并没有进入牙的外展隙，不能防止食物的嵌塞（B错）。延伸卡环又称为长臂卡环，卡环臂较长，与基牙接触面积较大，细菌容易滞留，自洁作用较差（E错），增加了患龋的可能（D错）。